不属于（POP公约）严格禁止或限制使用的持久性有机污染物有
A. 硫丹
B. 六氯苯
C. 乐果
D. 毒杀酚
E. 氯丹

正确答案：C。乐果

解析：本题考查POP公约严格禁止或限制使用的持久性有机污染物。持久性有机污染物是指能持久存在环境中，并可借助大气、水、生物体等环境介质进行远距离迁移，通过食物链富集，对环境和人类健康造成严重危害的天然或人工合成的有机污染物质。目前POP公约严格禁止或限制使用的持久性有机污染物共有23种，分别是：艾氏剂、氯丹（E对）、DDT、狄氏剂、异狄氏剂、七氯、灭蚁灵、毒杀酚（D对）、六氯苯（B对）、多氯联苯、二噁英、呋喃、α-六氯环己烷、β-六氯环己烧、林丹、十氯酮、五氯苯、六溴联苯、四溴二苯醚和五溴二苯醚、六溴二苯醚和七溴二苯醚、全氟辛基磺酸及其盐类和全氟辛基磺酰氟、硫丹（A对）、六溴环十二烷。乐果（C错，为本题正确答案）不属于POP公约严格禁止或限制使用的持久性有机污染物。